睫状肌收缩时
A. 睫状小带紧张，晶状体变凸，适于看远物
B. 睫状小带紧张，晶状体变扁平，适于看远物
C. 睫状小带松弛，晶状体变凸，适于看近物
D. 睫状小带松弛，晶状体变扁平，适于看近物

正确答案：C。睫状小带松弛，晶状体变凸，适于看近物

解析：睫状肌收缩时，睫状突内伸，睫状小带松弛，晶状体变凸，适于看近物（C对）。